女，28岁。阴道分泌物增多5天。有不洁性交史。检查：右侧大阴唇可见10mm×10mm、硬韧、无痛隆起物。本例最可能的诊断是
A. 巨细胞病毒感染
B. 淋病
C. 生殖器疱疹
D. 尖锐湿疣
E. 梅毒

正确答案：E。梅毒

解析：青年女性患者，阴道分泌物增多5天。有不洁性接触史（梅毒主要通过性接触传播）。检查：右侧大阴唇可见10mm×10mm、硬韧、无痛隆起物（此为硬下疳的典型表现）。综合患者的病史、症状、体征和实验室检查，该患者可考虑诊断为梅毒（E对），梅毒是由梅毒螺旋体（苍白螺旋体）引起的一种全身慢性传染病，主要通过性接触传播，一期梅毒主要表现为硬下疳，是侵入部位发生的一种炎症反应，常为单个，直径约1cm，表面可发生糜烂或溃疡，溃疡底部及边缘质硬。巨细胞病毒感染（A错）在正常成年人中多为隐性感染或呈单核细胞增多症表现。淋病（B错）是由淋球菌引起的急性化脓性炎症，淋球菌主要侵犯泌尿生殖系统，对柱状上皮和移行上皮有特别的亲和力。生殖器疱疹（C错）是由单纯疱疹病毒（HSV）引起的性传播疾病，生殖器疱疹的基本临床过程是局部出现红斑，伴感觉异常，继之形成水疱，数天后破溃，并发细菌感染者溃疡有脓性分泌物，多有既往发病史等。尖锐湿疣（D错）是由HPV引起的性传播疾病，潜伏期通常为3个月，初起为小而尖的突起，逐渐扩大，淡红或暗红，质软，表面凹凸不平，呈疣状颗粒。